使用奥沙利铂后最需要关注的典型不良反应是
A. 神经毒性
B. 消化道反应
C. 肝毒性
D. 肾毒性
E. 血液毒性

正确答案：A。神经毒性

解析：本题考查奥沙利铂的典型不良反应。使用奥沙利铂后最需要关注的典型不良反应是神经毒性（A对）。铂类化合物的典型不良反应有消化道反应（恶心、呕吐、腹泻）、肾毒性、耳毒性、神经毒性、低镁血症等，也可出现骨髓功能抑制、过敏反应。由于分子结构上的差异，导致三种铂类化合物的各自毒性亦有所区别，如顺铂典型不良反应为恶心、呕吐、肾毒性和耳毒性，骨髓功能抑制相对较轻；卡铂引起的恶心和呕吐的严重程度比顺铂轻，引起肾毒性和耳毒性不良反应比顺铂少，但骨髓抑制比顺铂严重；奥沙利铂引起恶心、呕吐、肾毒性、耳毒性、骨髓抑制均较轻，但神经毒性强。奥沙利铂的神经毒性（包括感觉周围神经病）是剂量依赖性的，累积量超过800mg/m²时，部分患者可导致永久性感觉异常和功能障碍。